某女，4岁。壮热烦躁，面红，大汗出，口渴喜冷饮，尿少色黄便秘；舌红，苔黄，脉数。根据中医理论分析其病机是
A. 阴胜则阳病
B. 阳胜则阴病
C. 阴虚则热
D. 阳虚则寒
E. 阴虚则阳亢

正确答案：B。阳胜则阴病

解析：本题考查的是阴阳偏盛。某女，4岁。壮热烦躁，面红，大汗出，口渴喜冷饮，尿少色黄便秘；舌红，苔黄，脉数。根据中医理论分析其病机是阳胜则阴病（B对）。1.阴阳偏盛：又称“阴阳偏胜”，阴或阳的偏盛，主要是指“邪气盛则实”的实证。病邪侵入人体，必从其类。阳邪侵入人体，可形成阳偏盛，阴邪侵入人体，可形成阴偏盛。阳盛则热，阴盛则寒，明确地指出了阳偏盛和阴偏盛病机的临床表现特点。（1）阳盛：又称“阳偏盛”，是指机体在疾病过程中，出现的阳邪偏盛、功能亢奋、热量过剩的病机变化。由于阳是以热、动、燥为其特点，阳偏胜，即出现热象，所以说“阳胜则热”。如壮热、面红、目赤等，即是阳偏盛的具体表现。“阳胜则阴病”，即阳盛则阴虚。但从病机上必须区分阴的虚损程度。邪客于阳而致阳盛，此时由于阴的相对不足，从而出现实热证。如果由于阳盛而耗伤机体的阴液，此时阴由相对的不足转而成为绝对的虚亏，这就从实热证转化为虚热证或实热兼阴亏证。（2）阴盛：又称“阴偏盛”，是指机体在疾病过程中所出现的一种阴邪偏盛、功能障碍或减退、产热不足，以及病变性代谢产物积聚的病机变化。阴是以寒、静、湿为其特点，阴偏盛，就出现寒象，所以说“阴胜则寒”。如形寒、肢冷、舌淡等，即是阴偏胜的具体表现。“阴胜则阳病（A错）”，即阴盛则阳虚。但从病机上必须区分阳的虚损程度，邪客于阴而致阴盛，此时，由于阳的相对不足，从而出现实寒证。如果由于阴盛而耗伤机体的阳气，此时阳由相对的不足转而成为极度的虚亏，即从实寒证转化为虚寒证或实寒兼阳虚证。阴虚则热（C错）、阳虚则寒（D错）与阴虚则阳亢（E错）均属于阴阳偏衰。阴阳偏衰：阴或阳的偏衰，是指“精气夺则虚”的虚证。“精气夺”，实质上是包括了机体的精、气、血、津液等基本物质的不足及其生理功能的减退，同时也包括了脏腑、经络等生理功能的减退和失调。机体的精、气、血、津液和脏腑、经络等组织器官及其生理功能，均可区分为阴、阳两类属性。在正常的生理情况下，它们之间存在着相互制约、互根互用及相互转化的关系，维持着相对平衡的状态。如果由于某种原因，出现阴或阳的某一方面物质减少或功能减退时，必然不能制约对方而引起对方的相对亢盛，形成“阳虚则阴盛”“阳虚则寒”（虚寒）；“阴虚则阳亢”“阴虚则热”（虚热）的病变现象。（1）阳虚：又称“阳偏衰”，是指机体阳气虚损、功能减退或衰弱、热量不足的病机变化。阳气不足，一般以脾肾之阳虚为主，其中尤以肾阳为诸阳之本，所以，肾阳虚衰（命门之火不足）在阳偏衰的病机中占有极其重要的地位。阳虚则不能制阴，阳气的温煦功能减弱，经络、脏腑等组织器官的某些功能活动也因之而减退，血和津液的运行迟缓，水液不化而阴寒内盛，这就是阳虚则寒的主要机制。阳虚则寒，不但可见到面色白、畏寒肢冷、舌淡、脉迟等寒象，而且还有喜静踡卧、小便清长、下利清谷等虚象。（2）阴虚：又称“阴偏衰”，是指机体精、血、津液等物质亏耗，以及阴不制阳，导致阳相对亢盛、功能虚性亢奋的病机变化。阴液不足，一般以肝肾之阴为主，尤其是肾阴为诸阴之本，所以，肾阴不足在阴偏衰的病机中占有极其重要的地位。由于阴液不足，不能制约阳气，从而形成阴虚内热、阴虚火旺和阴虚阳亢等多种表现。例如，五心烦热、骨蒸潮热、颧红消瘦、盗汗、咽干口燥、舌红少苔、脉细数无力等，即是阴虚则热的表现。